“水平膳食宝塔”提示，每日每人大豆类摄入量相当于干豆50g，其目的主要是
A. 保证膳食纤维摄入
B. 保证水苏糖的摄入
C. 提高必需脂肪酸摄入水平
D. 提高膳食蛋白质质量
E. 补充人体必需氨损失

正确答案：D。提高膳食蛋白质质量

解析：谷类是优质蛋白质来源